与普通口服制剂相比，口服缓（控）释制剂的优点有
A. 可以减少给药次数
B. 提高患者的顺应性
C. 避免或减少峰谷现象，有利于降低药物的不良反应
D. 根据临床需要，可灵活调整给药方案
E. 制备工艺成熟，产业化成本较低

正确答案：A、B、C。可以减少给药次数；提高患者的顺应性；避免或减少峰谷现象，有利于降低药物的不良反应

解析：本题考查口服缓（控）释制剂的优点。口服缓释、控释制剂的优点主要有：（1）减少给药次数（A对），提高患者的用药顺应性（B对）；（2）血药浓度平稳，减少峰谷现象，有利于降低药物的毒副作用（C对）；（3）缓释、控释制剂种类多样。遇特殊情况，口服缓释、控释制剂往往不能立刻停止给药，不能灵活调节给药方案（D错）；制备成本较高（E错）。